牙槽突裂的手术治疗
A. 与唇裂修补术同期完成
B. 与腭裂修补术同期完成
C. 一般于9～11岁行自体骨移植
D. 在恒牙全部萌出后即可植骨修复
E. 在18岁生长发育基本完成后行自体移植

正确答案：C。一般于9～11岁行自体骨移植

解析：牙槽突植骨术一般于9～11岁时进行，即尖牙未萌，根形成1/2～2/3时。掌握“唇腭裂的序列治疗”知识点。